宫颈癌最常见的转移途径是
A. 直接蔓延
B. 子宫颈旁淋巴结
C. 血道
D. 腹腔淋巴结
E. 种植性转移

正确答案：A。直接蔓延

解析：子宫颈癌最常见的转移途径为直接蔓延（A对），常向下累计阴道壁，极少向上由子宫颈管累计子宫。最重要的转移途径为淋巴转移，常延淋巴管扩散，包括宫旁、子宫颈旁、髂内、髂外、腹股沟深浅淋巴结及腹主动脉旁淋巴结等（BD错）。血行转移（C错）极少见，大多数发生在癌症晚期，可转移至肺、肝或骨骼等。种植性转移（P92）一般不见于宫颈癌，常见于胃肠道黏液癌侵及浆膜后，种植到大网膜、腹腔、盆腔器官如卵巢等处（E错）。